食物链的概念是
A. 生物与生物间因化学因素而建立的链锁关系
B. 生物与生物间因食物和能量而建立的链锁关系
C. 生物与环境间因食物而建立的链锁关系
D. 生物与环境间因能量而建立的链锁关系
E. 生物与生物之间因能量而建立的链锁关系

正确答案：B。生物与生物间因食物和能量而建立的链锁关系

解析：本题考查食物链的概念。食物链是生物与生物间因食物和能量而建立的链锁关系（B对ACDE错）。